产地加工需蒸制杀死蚜虫的药材是
A. 天麻
B. 红参
C. 五倍子
D. 连翘
E. 女贞子

正确答案：C。五倍子

解析：本题考查五倍子的采收加工。五倍子（C对）【采收加工】秋季五倍子由青转成黄褐色，成熟爆裂前采摘，置沸水中略煮或蒸至外表面变成灰色，杀死蚜虫。取出，干燥。天麻（A错）【采收加工】立冬后至次年清明前采挖，除去地上苗茎，立即洗净，蒸至透心，敞开低温干燥。红参（B错）【采收加工】秋季采挖，洗净，蒸制后，干燥。连翘（D错）【采收加工】秋季果实初熟尚带绿色时采收，除去杂质，蒸熟，晒干，习称“青翘”；果实熟透时采收，晒干，除去杂质，习称“老翘”。女贞子（E错）【采收加工】冬季果实成熟时采收，除去枝叶，稍蒸或置沸水中略烫后，干燥；或直接干燥。